不经常用于深度净化市政供水的措施是
A. 活性炭吸附法
B. 超滤
C. 臭氧预氧化法
D. TiO₂光催化技术
E. 气浮技术

正确答案：E。气浮技术

解析：本题考查深度净化饮用水的方法。深度净化饮用水的方法有：1.物理吸附分离技术：①活性炭吸附法（A对）：该方法对色、臭、味、腐殖酸、微量污染物、总有机碳、总有机卤化物及总三卤甲烷等均有明显去除作用；②膜分离法：该方法常用的膜技术有微滤（MF）、超滤（UF）（B对）、纳滤（NF）和反渗透（RO）等；2.化学氧化技术：①预氧化技术：是通过在给水处理工艺前端投加氧化剂强化处理效果的一类预处理措施，臭氧应用较为广泛（C对）；②TiO₂光催化技术（D对）：该技术是利用强氧化剂的活性自由基（主要是轻自由基）参与反应，能够将多数有机物氧化分解并最终矿化为H₂0和CO₂等小分子；3.生物预处理技术：是指在常规给水处理工艺之前增设生物处理工艺，包括塔滤、生物转盘、生物滤池与接触氧化等生物膜技术，借助于微生物群体的新陈代谢活动，去除那些常规给水处理工艺不能有效去除的有机物、氨氮和亚硝酸盐等污染物。气浮技术（E错，为本题正确答案）是一种除藻方法，除藻效果较好。